药品生产企业应当向政府价格主管部门提供
A. 药品零售指导价格
B. 药品政府指导价格
C. 常用药品的价格
D. 药品政府定价
E. 药品生产经营成本

正确答案：E。药品生产经营成本

解析：本题考查药品经营者遵守药品价格管理的规定。药品上市许可持有人、药品生产企业、药品经营企业和医疗机构应当依法向药品价格主管部门提供其药品的实际购销价格和购销数量等资料（E对）。医疗机构应当向患者提供所用药品的价格清单，按照规定如实公布其常用药品的价格（C错），加强合理用药管理。及时发布药物相关信息，将不同类型的药品价格进行归类公示。